可摘局部义齿半解剖式人工牙的牙尖斜度是
A. 0°
B. 10°
C. 20°
D. 30°
E. 40°

正确答案：C。20°

解析：人工牙模拟老年人的（牙合）面磨耗，牙尖斜度略低，约为20°，又称为半解剖式牙。掌握“局部义齿人工牙及基托”知识点。